根据医疗机构药品集中采购管理的相关规定，医院应当严格按照药品购进合同约定的时间支付货款，从交货验收合格到付款不得超过
A. 20天
B. 30天
C. 60天
D. 90天

正确答案：B。30天

解析：本题考查改进药款结算方式。医院签订药品采购合同时应当明确采购品种、剂型、规格、价格、数量、配送批量和时限、结算方式和结算时间等内容。合同约定的采购数量应是采购计划申报的一个采购周期的全部采购量。医院应将药品收支纳入预算管理，严格按照合同约定的时间支付货款，从交货验收合格到付款不得超过30天（B对）。